某市共有4个城区，各城区社会经济状况、小学校数量均不同。为了解该市城区小学生的生长发育情况，应该开展
A. 横断面调查
B. 追踪性调查
C. 半纵向调查
D. 队列研究
E. 健康监测

正确答案：A。横断面调查